下述糖异生的生理意义中哪项错误
A. 维持血糖浓度恒定
B. 补充肝糖原
C. 调节酸碱平衡
D. 防止乳酸酸中毒
E. 蛋白质合成加强

正确答案：E。蛋白质合成加强